单糖浆可作为
A. 乳化剂
B. 助悬剂
C. 两者均是
D. 两者均不是

正确答案：B。助悬剂

解析：本题考查混悬剂。助悬剂（B对）系指能增加分散介质的黏度以降低微粒的沉降速度或增加微粒亲水性的附加剂。常用的助悬剂有：1.低分子助悬剂。如甘油、糖浆剂等，在外用混悬剂中常加入甘油。2.高分子助悬剂。可加入天然的高分子助悬剂，如阿拉伯胶、西黄蓍胶、桃胶、海藻酸钠、琼脂、淀粉浆等；也可加入合成或半合成高分子助悬剂，如甲基纤维素、羧甲纤维素钠、羟丙纤维素、卡波姆、聚维酮、葡聚糖等。乳化剂是指乳剂制备时，除油相与水相外，尚需要加入的能促使分散相乳化并保持稳定的物质。单糖浆不作为乳化剂使用（ACD错）。